有机磷农药中毒时，污染部位的清洗要用
A. 热水
B. 酒精
C. 肥皂水
D. 硼酸
E. 碳酸氢钠

正确答案：C。肥皂水